中药饮片的炮制方法不同，其作用也有所不同关于黄柏炮制作用的说法，正确的有
A. 酒炙可引的上行清血分湿热
B. 生用偏于泻火解毒、清热燥湿
C. 盐炙引药入肾，增强滋阴泻火作用
D. 土炒可增强补脾止泻的作用
E. 炒炭清湿热之中兼具涩性，用于治疗便血

正确答案：A、B、C、E。酒炙可引的上行清血分湿热；生用偏于泻火解毒、清热燥湿；盐炙引药入肾，增强滋阴泻火作用；炒炭清湿热之中兼具涩性，用于治疗便血

解析：本题考查的是黄柏的炮制作用。中药饮片的炮制方法不同，其作用也有所不同关于黄柏炮制作用的说法，正确的有酒炙可引的上行清血分湿热（A对），生用偏于泻火解毒、清热燥湿（B对），盐炙引药入肾，增强滋阴泻火作用（C对）与炒炭清湿热之中兼具涩性，用于治疗便血（E对）。黄柏：【炮制作用】黄柏味苦，性寒。归肾、膀胱经。具有泻火解毒，清热燥湿的功能。多用于湿热泄痢，黄疸，热淋，足膝肿痛，疮疡肿毒，湿疹，烫火伤等。①盐黄柏可引药入肾，缓和枯燥之性，增强滋肾阴、泻相火、退虚热的作用。多用于阴虚发热，骨蒸劳热，盗汗，遗精，足膝痿软，咳嗽咯血等。②酒黄柏可降低苦寒之性，免伤脾阳，并借酒升腾之力，引药上行，清血分湿热。用于热壅上焦诸证及热在血分。③黄柏炭清湿热之中兼具涩性，多用于便血、崩漏下血。土炒可增强补脾止泻的作用（D错）为白术的炮制作用。白术：【炮制作用】白术味甘、苦，性温。归脾、胃经。具有健脾益气，燥湿利水，止汗，安胎的功能。①白术以健脾燥湿、利水消肿为主，生品与炒品相比祛湿力强，用于脾虚食少，腹胀泄泻，痰饮眩悸，水肿，自汗，胎动不安。②土炒白术，借土气助脾气，长于补脾止泻而安胎，用于脾虚食少、泄泻便溏、胎动不安。③麸炒白术，借麸味甘入中之性，以缓和白术的燥性，增其健脾之功，并兼消胀之能。用于脾气虚弱、中焦不和、运化失常所致的食少胀满、倦怠乏力。